下面哪项不属于妇科病普查的内容
A. 宫内节育器
B. 宫颈刮片
C. 乳房
D. 内生殖器
E. 外生殖器

正确答案：A。宫内节育器

解析：本题考查妇科病普查的内容。宫内节育器（A错，为本题正确答案），俗称避孕环，是一种安全、长效、经济、简便的避孕工具。妇科病普查的内容有：外生殖器（E对）、内生殖器（D对）、子宫、输卵管和卵巢大小、位置、宫颈刮片（B对）、乳房（C对）的各项等检查。